催眠药使用时间
A. 饭前
B. 上午7～8点
C. 睡前
D. 饭后
E. 清晨起床后

正确答案：C。睡前

解析：本题考查催眠药的使用时间。催眠药使用时间是睡前（C对）。助消化药使用时间是饭前（A错）。糖皮质激素使用时间为上午7～8点（B错）。